男，33岁。突发头痛，右眼睑下垂，右瞳孔扩大，直接和间接对光反射消失，左侧间接对光反射正常。则损伤的部位可能在
A. 左侧视神经及动眼神经
B. 左侧动眼神经
C. 右侧动眼神经
D. 特异性投射系统
E. 非特异性投射系统

正确答案：C。右侧动眼神经

解析：动眼神经为支配眼肌的主要运动神经，动眼神经起自中脑上丘的动眼神经核，该核分为三部分：（1）外侧核：支配上睑提肌、上直肌、内直肌、下斜肌、下直肌；（2）内侧核：支配两眼内直肌，主管两眼的辐辏运动；（3）E-W核：副交感神经节前纤维支配瞳孔括约肌和睫状肌，司瞳孔缩小及晶状体变厚而视近物，参与缩瞳和调节反射。动眼神经核受双侧皮质脑干束支配，动眼神经核发出的动眼神经支配同侧的眼肌。故动眼神经损伤表现为同侧上睑下垂，眼球向外下斜视，不能向上、向内、向下转动，复视，瞳孔散大，光反射及调节反射均消失。该患者的表现符合右侧动眼神经（C对）损伤的表现，其左侧间接对光反射正常提示左侧动眼神经（AB错）无损伤。特异性投射系统（D错）是指从丘脑发出的纤维，投射到大脑皮层的特定区域，具有程度很高的点对点的投射关系，其主要功能是引起特定的感觉，如皮肤浅感觉、深感觉、听觉、视觉、味觉（除嗅觉外）等，故特异性投射系统受损会导致特定的感觉障碍。非特异性投射系统（E错）可分为网状结构上行激动系统及丘脑非特异性投射系统两部分，其主要功能是维持和改变大脑皮层的兴奋状态，若非特异性投射系统受损，患者会陷入昏睡状态。